关于白喉毒素，错误的是
A. 对原核生物有剧毒
B. 是一种毒素蛋白
C. 干扰蛋白质生物合成
D. 是一种修饰酶
E. 极低剂量即发生效应

正确答案：A。对原核生物有剧毒